与受体结合及解离速度较快，较少引起严重低血糖的磺酰脲类药物是
A. 格列齐特
B. 格列吡嗪
C. 格列美脲
D. 格列喹酮
E. 格列本脲

正确答案：C。格列美脲

解析：本题考查口服降糖药的作用特点。格列美脲（C对）与受体结合及离解的速度皆较格列本脲为快，较少引起较重的低血糖。格列本脲（E错）是第二代磺酰脲类口服降糖药，降血糖的作用机制是刺激胰岛B细胞分泌胰岛素；增加门静脉胰岛素水平，直接抑制肝糖原分解和糖原异生作用，使肝生成和输出葡萄糖减少；增加胰外组织对胰岛素的敏感性和糖的应用。格列齐特（A错）、格列吡嗪（B错）作用机制同格列本脲。格列喹酮（D错）口服吸收快，95%经肝脏代谢，主要经胆汁从粪便排出，仅有5%经肾排泄。